因下颌阻生牙牙根本身的解剖形态所产生的阻碍该牙拔除的力，称
A. 牙冠部软组织阻力
B. 牙根部阻力
C. 牙冠部骨组织阻力
D. 邻牙阻力
E. 牙根部骨组织阻力

正确答案：B。牙根部阻力

解析：本题考查下颌阻生第三磨牙拔除的阻力分析。因下颌阻生牙牙根本身的解剖形态所产生的阻碍该牙拔除的力，称牙根部阻力（B对）。下颌阻生牙拔除时的阻力产生于三个部位：①冠部阻力，牙冠部的阻力包括软组织阻力和骨组织阻力。牙冠部软组织阻力来自阻生牙上方覆盖的龈片（A错）；牙冠部骨组织阻力来自于包裹阻生牙牙冠的骨组织（C错），主要是牙冠外形高点以上的骨质。 ②根部阻力，是拔牙需克服的主要阻力，包括下颌阻生牙牙根本身的解剖形态所产生的阻碍该牙拔除的力和牙根部骨组织阻力（E错）即取决于根周骨质情况的阻力。③邻牙阻力，是第二磨牙在拔除阻生智牙时产生的妨碍脱位运动的阻力（D错）。